重组DNA的连接方式不包括
A. 黏性末端连接
B. 平头末端连接
C. 黏性末端与平头末端连接
D. DNA连接子技术
E. DNA适配子技术

正确答案：C。黏性末端与平头末端连接